关于硫黄软膏治疗疥疮的用法，错误的是
A. 成人使用10%的软膏，儿童使用5%或2.5%的软膏
B. 用药期间勤用热水洗澡
C. 每晚涂药1次，疗程为3-4天
D. 对顽固患者必需3个疗程方能根治
E. 用药期间应避免接触铜制品

正确答案：B。用药期间勤用热水洗澡

解析：本题考查硫黄软膏的使用。关于硫黄软膏治疗疥疮的用法，错误的是用药期间勤用热水洗澡（B错，为本题正确选项）。硫黄软膏外用治疗疥疮时应涂抹在全身，儿童应用5%，成人应用10%（A对），每晚各涂一次，连续3日（C对），此间不洗澡，不更衣。3日后洗澡，更衣。对顽固的患者必需3个疗程才能根治（D对）。用药期间不得与铜制品接触（E对）。